治疗呕吐热邪内蕴者，宜点刺出血的是
A. 金津 玉液
B. 中脘 关元
C. 厉兑 内庭
D. 公孙 合谷
E. 厉兑 商阳

正确答案：A。金津 玉液

解析：治疗呕吐热邪内蕴可点刺金津、玉液（A对）。中脘、关元宜直刺（B错）。厉兑宜浅刺，内庭宜直刺或斜刺（C错）。公孙、合谷宜直刺（D错）。厉兑，商阳宜浅刺（E错）。